可摘局部义齿出现翘动、摆动、上下动的现象解决的方案是
A. 修改卡环臂
B. 基托重衬
C. 基托缓冲
D. 重新排列人工牙
E. 修改卡环与支托，或重新制作卡环

正确答案：E。修改卡环与支托，或重新制作卡环

解析：翘动、摆动、上下动：原因是卡环体与基牙不贴合，间接固位体放置的位置不当，支托、卡环在牙面形成支点，卡环无固位力。处理方法：修改卡环与支托，或重新制作卡环。掌握“局部义齿修复后出现的问题及处理”知识点。